关于脂质体特点和质量要求的说法，正确的是
A. 脂质体的药物包封率通常应在10%以下
B. 药物制备成脂质体，提高药物稳定性的同时增加了药物毒性
C. 脂质体为被动靶向制剂，在其载体上结合抗体，糖脂等也可使其具有特异靶向性
D. 脂质体形态为封闭多层囊状物，贮存稳定，不易产生渗漏现象
E. 脂质体是理想的靶向抗肿瘤药物载体，但只适用于亲脂性药物

正确答案：C。脂质体为被动靶向制剂，在其载体上结合抗体，糖脂等也可使其具有特异靶向性

解析：本题考查脂质体。脂质体为被动靶向制剂，在其载体上结合抗体，糖脂等也可使其具有特异性、靶向性（C对）。脂质体的药物包封率通常要求达到80%以上（A错）。药物制备成脂质体，提高药物稳定性的同时降低了药物毒性（B错）。脂质体存在渗漏现象，脂质体对某些水溶性药物包封率较低，药物易从脂质体中渗漏出来（D错）。脂质体的靶向性主要由不同部位的网状内皮系统决定，主要用于肿瘤的治疗，其优点是可以包裹不同化学性质和大小的物质（E错）。